子宫前倾指的是
A. 子宫体与子宫颈形成的向前开放的钝角
B. 子宫体与底之间形成的向前开放的钝角
C. 子宫体、颈之间开口向前的90度角
D. 子宫和阴道之间形成的向前开放的钝角
E. 子宫和阴道之间形成的向前开放的90度角

正确答案：D。子宫和阴道之间形成的向前开放的钝角

解析：子宫前是子宫与阴道之间形成的向前开放的钝角（B错D对），略大于 90°（E错） ；前屈是指子宫体与子宫颈不在一条直线上，两者间形成一个向前开放的钝角（A错），约 170°（C错）。